主要存在于牛黄中的是
A. 精氨酸
B. 强心甾烯
C. 麝香酮
D. 蟾蜍甾二烯
E. 鹅去氧胆酸

正确答案：A。精氨酸